新型隐球菌的主要传播方式是
A. 病人-咳痰-飞沫传播
B. 鸽子-粪便-呼吸道传播
C. 病人-粪便-消化道传播
D. 病人-粪便-呼吸道传播
E. 人虱-粪便-破损皮肤传播

正确答案：B。鸽子-粪便-呼吸道传播